老年男性，溃疡穿孔单纯修补术一周，体温38.5℃，右上腹痛，肝区叩痛，右肺下野呼吸音弱。X线右膈升高，可能并发
A. 右下肺炎
B. 急性胆囊炎
C. 再穿孔
D. 右膈下脓肿
E. 急性胰腺炎

正确答案：D。右膈下脓肿

解析：腹部手术+发热+上腹痛+X线透视可见病侧膈肌升高=膈下脓肿，故答案选择右膈下脓肿（D对）。右下肺炎（A错）X线会出现肺部改变，不会有右上腹痛和肝区叩痛。急性胆囊炎（B错）表现为右上腹绞痛或持续性疼痛伴阵发加剧，疼痛向右肩放射，右上腹局部压痛、反跳痛。再穿孔（C错）主要表现为腹痛，腹部压痛、反跳痛和腹肌紧张等腹膜刺激症状。急性胰腺炎（E错）主要症状为腹痛、恶心、呕吐、腹膜炎体征等。